下列属于淋病奈瑟菌的特征的是
A. 离开人体可存活4小时
B. 为革兰染色阴性双球菌
C. 对移行上皮无亲和力
D. 一般消毒剂不易将其杀灭
E. 对复层鳞状上皮有亲和力

正确答案：B。为革兰染色阴性双球菌

解析：淋病奈瑟菌俗称淋球菌，是革兰染色阴性双球菌（B对），在中性粒细胞内发现革兰阴性双球菌，具有诊断价值；淋病奈瑟菌抵抗力弱，对热、冷、干燥和消毒剂极度敏感，一般消毒剂易将其杀灭（D错），在完全干燥的环境中1～2h即死亡，在50℃仅能存活5min（A错）；淋病奈瑟菌是引起人类泌尿生殖系统黏膜化脓性感染（淋病）的病原菌，因此淋病奈瑟菌对柱状上皮和移行上皮（来自于肾盂、输尿管、膀胱和尿道近膀胱段等处）有亲和力（C错），对复层鳞状上皮（来自皮肤表皮、口腔）无亲和力（E错）。